不属于拔牙适应证的一项是
A. 牙外伤冠折
B. 引起正常牙萌出障碍的多生牙
C. Ⅲ度松动的牙齿
D. 妨碍义齿修复的移位牙
E. 冠根联合折无保留价值的牙

正确答案：A。牙外伤冠折

解析：严重广泛不能修复的龋坏，如残根、残冠，是拔牙的适应证，牙外伤冠折可行相应的治疗和修复。掌握“牙拔除的适应证与禁忌证”知识点。